一般所说的生物地球化学性疾病主要是指
A. 自然疫源性疾病
B. 地质环境因素引起的疾病
C. 环境污染所致公害病
D. 遗传性疾病
E. 区域内的传染病

正确答案：B。地质环境因素引起的疾病

解析：考查生物地球化学性疾病的概念。生物地球化学性疾病：指由于地球地壳表面化学元素分布不均匀，使某些地区的水和（或）土壤中某些元素过多或过少，而引起的某些特异性疾病。所以生物地球化学性疾病是一种由地质环境因素引起的疾病（B对）。